伤寒的临床特点不包括
A. 玫瑰疹
B. 肝脾大
C. 血白细胞升高
D. 持续发热
E. 相对缓脉

正确答案：C。血白细胞升高

解析：伤寒常见的临床表现有持续发热（D对）、相对缓脉（E对）、玫瑰疹（A对）、肝脾大（B对）、血中白细胞降低（C错，为本题正确答案）。